分离原理主要为氢键缔合的吸附剂是
A. 活性炭
B. 聚酰胺
C. 硅藻土
D. 氧化铝
E. 反相硅胶

正确答案：B。聚酰胺

解析：本题考查的是吸附剂的吸附原理。分离原理主要为氢键缔合的吸附剂是聚酰胺（B对）。聚酰胺吸附属于氢键吸附，力量较弱，介于物理吸附与化学吸附之间，也称半化学吸附。聚酰胺对黄酮类、醌类等化合物之间的氢键吸附效果较好，特别适合分离酚类、醌类、黄酮类化合物。活性炭（A错）是非极性吸附剂，与硅胶、氧化铝相反，对非极性物质具有较强的亲和能力，在水中对溶质表现出强的吸附能力。溶剂极性降低，则活性炭对溶质的吸附能力也随之降低。故从活性炭上洗脱被吸附物质时，洗脱溶剂的洗脱能力将随溶剂极性的降低而增强。硅藻土（C错）可作为液-液分配柱色谱的载体。氧化铝（D错）为吸附剂，分离原理都是根据吸附能力大小不同进行分离。另外，氧化铝又分为酸性或碱性氧化铝，如黄酮等酚酸性物质被碱性氧化铝的吸附，或生物碱被酸性氧化铝的吸附等，这又属于化学吸附。常用反相硅胶（E错）薄层及柱色谱的填料系将普通硅胶进行化学修饰，键合上长度不同的烃基（R）、形成亲油表面而成。